布鲁姆提出的环境健康医学模式中指出影响人类健康的四大因素为
A. 社会因素、遗传、卫生服务质量、行为生活方式
B. 环境、遗传、心理、生活方式
C. 环境、遗传、卫生服务、行为生活方式
D. 心理、遗传、卫生服务、行为生活方式
E. 环境、心理、社会因素、遗传

正确答案：C。环境、遗传、卫生服务、行为生活方式

解析：本题考查布鲁姆的环境健康医学模式。布鲁姆认为环境因素，特别是社会环境因素，对人们健康、精神和生理发育有重要影响，提出了包括环境、遗传、行为与生活方式和医疗卫生服务（C对ABDE错）等4个因素的环境健康医学模式。